患者，男，56岁。肺心病病史6年，前日酒后受凉，发热，咳喘大作，咯吐黄痰，舌暗苔黄腻，脉滑数。其证型是
A. 痰浊阻肺
B. 痰热壅肺
C. 寒饮内停
D. 痰蒙清窍
E. 风热犯肺

正确答案：B。痰热壅肺

解析：痰热壅阻肺气，肺失清肃，故咳喘大作，咯吐黄痰；肺热内蕴则有身热；舌暗苔黄腻，脉滑数均为痰热郁肺之侯，其证型为痰热壅肺证（B对）。痰浊阻肺（A错）的特点为咳嗽反复发作，咳声重浊，痰多，因痰而嗽，痰出咳平，痰黏腻色白，胸闷，脘痞。寒饮内停（C错）的特点为畏寒肢冷，咳痰清稀量多。痰蒙清窍（D错）的特点为神志恍惚，抽搐，痰白腻或黄腻，舌质暗红，脉细滑数。风热犯肺（E错）的特点为咳嗽频剧，气粗或咳声嘶哑，喉燥咽痛，痰粘稠或黄，常伴表证。